急性放射病根据临床表现可以分为三型，其中不包含
A. 脑型
B. 骨髓型
C. 心血管型
D. 胃肠型

正确答案：C。心血管型

解析：本题考查急性放射病的三种类型。不同剂量照射引起的外照射急性放射病分为不同的类型。根据其临床表现和病理改变分为骨髓型（B对）、肠型（D对）、脑型（A对）。目前未分类出心血管型的急性放射病（C错，为本题正确答案）。其病程一般有较明显的时相性，通常有初期、假愈期、极期三个阶段，但不同类型的放射病又不尽相同。